下列哪项不是切开引流的目的
A. 使脓液或腐败坏死物迅速排出体外，消炎解毒
B. 解除局部疼痛、肿胀及张力
C. 使坏死感染物扩散全身，造成全身性败血症
D. 颌周间隙脓肿引流，以免并发边缘性骨髓炎
E. 预防感染向颅内和胸腔扩散或侵入血液循环，发生海绵窦血栓等严重并发症

正确答案：C。使坏死感染物扩散全身，造成全身性败血症

解析：切开引流的目的：①使脓液或腐败坏死物迅速排出体外，以达消炎解毒的目的；②解除局部疼痛、肿胀及张力，以防发生窒息（如舌根部、口底间隙脓肿）；③颌周间隙脓肿引流，以免并发边缘性骨髓炎；预防感染向颅内和胸腔扩散或侵入血液循环，发生海绵窦血栓、脑脓肿、纵隔炎、败血症等严重并发症。掌握“口腔颌面部感染概论”知识点。